患者，男性，35岁。上唇部肿胀疼痛3天，伴发热症状，肿胀的唇部皮肤与黏膜上出现多数的黄白色脓头，破溃后溢出脓血样分泌物，病变区呈紫红色，体温38.5℃。该患者的治疗方案中，不恰当的是
A. 限制唇部活动
B. 全身应用抗生素
C. 卧床休息，加强营养
D. 早期挤压、挑刺或切开引流
E. 高渗盐水或含抗生素的盐水纱布局部持续湿敷

正确答案：D。早期挤压、挑刺或切开引流

解析：严禁挤压、挑刺、热敷或用苯酚、硝酸银烧灼，以防感染扩散。唇痈还应限制唇部活动。掌握“面部疖痈”知识点。